男，25岁，过量饮酒后，被同桌酒友送到医院，酒友在未支付医疗费的情况下，匆忙离开医院，医院无法联系到患者的家人。此时，患者血压下降，面色苍白，皮肤湿冷，瞳孔散大。经首诊医师初步判断，为急性酒精中毒，经全力抢救后，患者已经转危为安了。此时的医疗模式是
A. 共同参与型
B. 主动被动型
C. 主动合作型
D. 指导参与型
E. 指导合作型

正确答案：B。主动被动型

解析：主动－被动模式：这种模式适用于昏迷、休克、精神病患者发作期、严重智力低下者以及婴幼儿等一些难以表达主观意志（B对）的患者；指导合作模式：这种模式适用于大多数患者（E错）；共同参与模式：这种模式适用于具有一定医学知识背景或长期的慢性病患者（A错）。